具有化痰软坚作用的炮制辅料是
A. 河砂
B. 滑石粉
C. 稻米
D. 灶心土
E. 蛤粉

正确答案：E。蛤粉

解析：本题考查的是固体辅料及其应用。具有化痰软坚作用的炮制辅料是蛤粉（E对）。中药炮制辅料是指中药炮制过程中，除主药以外所加入的具有辅助作用的附加物料。常用的辅料可分为液体辅料和固体辅料。固体辅料及其作用。（1）麦麸：麦麸味甘、淡，性平。能和中益脾。与药物共制能缓和药物的燥性，增强疗效，除去药物不良气味，使药物色泽均匀一致。（2）河砂（A错）：应用河砂作为中药炮制的辅料，主要是作中间传热体，利用其温度高、传热快的特点，使质地坚韧的药物质地酥脆，或使药物膨大鼓起，便于粉碎和利于有效成分的溶出。此外，还可利用河砂温度高，破坏部分毒副作用成分而降低药物的毒副作用，去除非药用部位及矫味矫臭等。（3）稻米（C错）：稻米味甘，性平。能补中益气，健脾和胃，除烦止渴，止泻痢。与药物共制，可增强药物疗效，降低刺激性和毒性。（4）土：灶心土（D错）味辛，性温。能温中和胃，止血，止呕，涩肠止泻等。与药物共制后可降低药物的刺激性，增强药物疗效。（5）滑石粉（B错）：滑石粉味甘，性寒。能利尿，清热，解暑。中药炮制常用滑石粉作中间传热体拌炒药物，可使药物受热均匀。（6）蛤粉：蛤粉味咸，性寒。能清热，利湿，化痰，软坚。与药物共制可除去药物的腥味，增强疗效。